组成tRNA的核苷酸约为
A. 33～53
B. 53～73
C. 73～93
D. 73～113
E. 93～113

正确答案：C。73～93

解析：tRNA是单链小分子，由73～93个核苷酸组成。掌握“RNA”知识点。